下列哪项不是胃痛脾胃虚寒证的表现
A. 胃痛隐隐，喜温喜按
B. 空腹痛甚，得食痛减
C. 手足不温
D. 遇寒痛增，暴作
E. 泛吐清水

正确答案：D。遇寒痛增，暴作

解析：脾胃虚寒，病属正虚，故胃痛隐隐；寒得温而散，气得按而行所以喜温喜按（A错）。寒主收引，寒邪内客于胃，则阳气被寒邪所遏而不得舒展，故手足不温（C错），泛吐清水（E错）。脾胃虚寒，故空腹痛甚，纳差；胃虚得食，则产热助正以抗邪，所以得食痛减（B错）。脾胃虚寒是属慢性久病，非受寒直中之寒实之证，故不是遇寒痛增，暴作之象（D对）。